试用期人员开具处方符合下列哪项条件方可有效
A. 所在医疗机构执业医师的审核、签名
B. 所在医疗机构执业医师的签名
C. 所在医疗机构执业医师加盖专用签章后方有效
D. 所在医疗机构有处方权的执业医师签名
E. 所在医疗机构有处方权的执业医师审核、并签名

正确答案：E。所在医疗机构有处方权的执业医师审核、并签名

解析：试用期人员开具处方，应当经所在医疗机构有处方权的执业医师审核、并签名或加盖专用签章后方有效。掌握“处方管理概述及一般规定、处方权”知识点。